《麻醉药品和精神药品管理条例》中规定，医疗机构使用麻醉药品，第一类精神药品的，首先应该取得
A. 麻醉药品、第一类精神药品供货商
B. 麻醉药品、第一类精神药品相关原材料
C. 麻醉药品、第一类精神药品使用权
D. 麻醉药品、第一类精神药品生产权
E. 麻醉药品、第一类精神药品购用印鉴卡

正确答案：E。麻醉药品、第一类精神药品购用印鉴卡

解析：《麻醉药品和精神药品管理条例》规定，医疗机构需要使用麻醉药品和第一类精神药品的，应当经所在地设区的市级人民政府卫生主管部门批准，取得麻醉药品、第一类精神药品购用印鉴卡（简称印鉴卡）。掌握“麻醉、精神药品的使用及法律责任”知识点。